患者，女，29岁，已婚。因分娩时受寒，产后小腹疼痛，拒按，恶露量少、行而不畅、色黯、有块，四肢不温，面色青白，脉沉紧。治疗应首选
A. 温经汤(《妇人大全良方》)
B. 肠宁汤
C. 温胞饮
D. 生化汤
E. 川楝汤

正确答案：D。生化汤

解析：患者分娩时受寒，产后腹痛，恶露量少，行而不畅，色黯，有块，四肢不温，面色青色均为寒凝血瘀之征，治疗要活血化瘀，温经止痛，故用生化汤（D对）。温经汤（《妇人大全良方》）功效温经散寒调经，治经道不通，绕脐寒疝痛彻，其脉沉紧者，如月经后期实寒证（A错）。肠宁汤（《傅青主女科》）功效补血益气，缓急止痛，治产后血虚肠燥之少腹痛，如产后腹痛气血两虚证（B错）。温胞饮功效温肾暖宫，调补冲任，治月经迟发，或月经推后，或停闭不行，经色黯淡，性欲冷淡，小腹冷，带下量多，清稀如水，如不孕肾阳虚证（C错）。川楝汤暖肝通络，软坚消肿，可用于治疗肝气郁滞或疝气（E错）